毒性药品每张处方不得超过
A. 七日常用量
B. 二日常用量
C. 三日常用量
D. 二日极量
E. 三日极量

正确答案：D。二日极量

解析：本题考查处方限量。毒性药品每张处方不得超过二日极量（D对）。医疗机构供应和调配毒性药品，须凭执业医师签名的正式处方。具有毒性药品经营资格的零售药店，供应和调配毒性药品时，须凭盖有执业医师所在的医疗机构公章的正式处方。每次处方剂量不得超过二日极量。